生物药剂学中影响药物体内过程的生物因素不包括
A. 种族差异
B. 性别差异
C. 年龄差异
D. 用药方法
E. 遗传因素

正确答案：D。用药方法

解析：本题考查影响药物体内过程的生物因素。生物药剂学中影响药物体内过程的生物因素不包括用药方法（D错，为本题正确答案）。影响药物体内过程的生物因素：1.种属差异（A对）；2.性别差异（B对）；3.年龄差异（C对）；4.生理与病理条件差异；5.遗传因素（E对）。